医疗机构药剂人员调配处方时的错误行为是
A. 处方必须经过核对，对处方所列药品不得擅自更改
B. 处方所列药品缺货时用同类药品代用
C. 对有配伍禁忌的处方，应当拒绝调配
D. 对有超剂量的处方，应当拒绝调配
E. 必要时，经处方医师更正或重新签字，方可调配

正确答案：B。处方所列药品缺货时用同类药品代用

解析：医疗机构药剂人员调配处方时，对处方所列药品不得擅自更改（A对），不得在处方所列药品缺货时用同类药品代用（B错，为本题正确答案）。对于配伍禁忌或者超剂量的处方，应当拒绝调配（CD对），必要时，经处方医师更正或者重新签字，方可调配（E对）。